具有散瘀消痈功效的药物是
A. 大蓟
B. 地榆
C. 槐花
D. 白茅根
E. 侧柏叶

正确答案：A。大蓟

解析：该题考查大蓟的功效，属记忆内容。大蓟味甘、苦，性凉；入心、肝经，具有凉血止血，散瘀解毒消痈的功效（A对）。地榆具有凉血止血，解毒敛疮的功效，没有散瘀消痈的功效（B错）。槐花具有凉血止血，清肝泻火的功效，没有散瘀消痈的功效（C错）。白茅根具有凉血止血，清热利尿，清肺胃热的功效没有散瘀消痈的功效（D错）。侧柏叶具有凉血止血，化痰止咳的功效（E错）。